某女，72岁，患有高血压、冠心病。近日喘咳气涌，痰黏色黄，伴胸中烦闷，身热，有汗。舌红苔黄腻，脉滑数。中医辨证为痰热郁肺。治法为清热化痰、宣肺止咳。治宜选用的方剂是
A. 华盖散
B. 杏苏散
C. 参苏饮
D. 百合固金汤
E. 桑白皮汤

正确答案：E。桑白皮汤

解析：本题考查的是喘证的辨证论治。中医辨证为痰热郁肺。治法为清热化痰、宣肺止咳。治宜选用的方剂是桑白皮汤（E对）。喘即气喘、喘息。喘证是以呼吸困难，甚至张口抬肩、鼻翼扇动、不能平卧为特征的疾病。（一）风寒闭肺证：【方剂应用】基础方剂为麻黄汤（麻黄、杏仁、桂枝、炙甘草）合华盖散（A错）（麻黄、杏仁、桑白皮、紫苏子、茯苓、陈皮）加减。（二）痰热壅肺证：【方剂应用】基础方剂为桑白皮汤（桑白皮、半夏、苏子、苦杏仁、贝母、黄芩、黄连、栀子）加减。（三）痰浊阻肺证：【方剂应用】基础方剂为二陈汤（陈皮、半夏、茯苓、甘草、生姜、乌梅）合三子养亲汤（紫苏子、白芥子、莱菔子）加减。（四）肾不纳气证：【方剂应用】基础方剂为肾气丸（桂枝、附子、熟地、山萸肉、山药、茯苓、丹皮、泽泻）合参蛤散（人参、蛤蚧）加减。杏苏散（B错）是咳嗽风燥伤肺证的方剂应用。咳嗽风燥伤肺证：【方剂应用】基础方剂为桑杏汤（桑叶、苦杏仁、沙参、象贝、香豉、栀子、梨皮）加减。参苏饮（C错）是气虚感冒的方剂应用。气虚感冒：【方剂应用】基础方剂为参苏饮（人参、苏叶、甘草、茯苓、葛根、前胡、半夏、枳壳、桔梗、陈皮、木香）加减。百合固金汤（D错）是咳嗽肺阴亏耗证的中成药应用。咳嗽肺阴亏耗证：【方剂应用】基础方剂为沙参麦冬汤（沙参、玉竹、生甘草、冬桑叶、麦冬、生扁豆、天花粉）加减。【中成药应用】常用中成药有养阴清肺膏、百合固金丸、二冬膏。